心理冲突的类型不包括
A. 双避冲突
B. 双趋冲突
C. 趋避冲突
D. 多重趋避冲突
E. 矛盾冲突

正确答案：E。矛盾冲突

解析：动机反映了一个人主观的、内在的心理状态。动机的强度会随着内外环境的变化而改变。在同一时间内人们常常存在着两种或多种非常相似或相互矛盾的动机，这就是动机冲突。动机冲突有双趋冲突（B对）、双避冲突（A对）、趋避冲突（C对）、双重趋避式冲突（D对）（E错，为本题正确选项）。双趋冲突指两个目标具有相同的吸引力，引起同样强度的动机。 但由于受条件等因素的限制，无法同时实现，二者必择其一，即所谓“鱼和熊掌不可兼得”。双避冲突指一个人同时受到两种事物的威胁，产生同等强度的逃避动机，但迫于情势，必须接受其中一个，才能避开另一个，处于左右为难，进退维谷的紧张状态。所谓“前有狼，后有虎”的矛盾冲突。趋避冲突指一个人对同一事物同时产生两种动机，即向往得到它，同时又想拒绝和避开它。双重趋避式冲突指人们常常会遇到多个目标，每个目标对自己都有利也都有弊，反复权衡拿不定主意所产生的冲突。如临床上对某一疾病有两种治疗方案，一种风险高疗效快，另一种风险低但疗效不显著，选择哪种方案，难以拿定主意。